年轻恒牙牙髓治疗的治疗原则为
A. 保存生活的牙髓组织
B. 维持牙列完整行使功能
C. 不刺激根尖周组织
D. 牙髓活力正常有利于颌骨及颅面的发育
E. 减少患者就诊次数

正确答案：A。保存生活的牙髓组织

解析：年轻恒牙萌出后，牙根的继续发育有赖于牙髓的作用。因此，在牙髓病的治疗中，保存生活牙髓应是最有益于年轻恒牙的首选治疗。掌握“年轻恒牙牙髓病及根尖周病诊断及治疗”知识点。